白细胞聚集介导缺血－再灌注损伤的机制不包括
A. 阻塞微循环
B. 增加血管通透性
C. 释放活性氧
D. 释放溶酶体酶
E. 能量代谢障碍

正确答案：E。能量代谢障碍

解析：白细胞聚集介导缺血－再灌注损伤的机制：1. 微血管损伤(1) 微血管血液流变学改变：缺血－再灌损伤可引起大量中性粒细胞聚集、黏附在血管内皮细胞上，而且不易分离，极易嵌顿、阻塞微循环（A对）血管。(2) 增加血管通透性（B对）2. 细胞损伤 激活的中性粒细胞与血管内皮细胞可释放大量的活性物质，如释放活性氧（C对）、释放蛋白酶、释放溶酶体酶（D对）等，不但改变了自身的结构和功能，而且造成周围组织细胞损。能量代谢障碍（E错，为本题正确答案）不是白细胞聚集介导缺血－再灌注损伤的机制。